女性乳房外侧部淋巴回流主要注入
A. 腋尖淋巴结
B. 胸肌淋巴结
C. 隔下淋巴结
D. 胸骨旁淋巴结
E. 腋腔外侧淋巴结

正确答案：B。胸肌淋巴结

解析：胸肌淋巴结（B对）为女性乳房外侧部淋巴回流主要注入部位，其输出淋巴管注入中央淋巴结和尖淋巴结。